关于虹膜的描述，何项是错误的
A. 为一环行薄膜
B. 富含血管
C. 含丰富色素细胞
D. 含大量感光细胞
E. 主要为疏松结缔组织

正确答案：D。含大量感光细胞

解析：虹膜为一环行薄膜（A对），属于血管膜，故富含血管（B对），含丰富色素细胞（C对），但不含感光细胞（D错，为本题正确答案）。含大量感光细胞的是视网膜。虹膜主要为疏松结缔组织（E对）。